大黄的使用注意，下列哪项说法不妥
A. 妇女月经期慎用
B. 妇女哺乳期慎用
C. 孕妇便秘慎用
D. 孕妇忌用
E. 阴疽忌用

正确答案：E。阴疽忌用

解析：大黄的使用注意：孕妇（CD对）及月经期（A对）、哺乳期（B对）慎用。又因大黄苦寒，易伤胃气，脾胃虚弱者亦应慎用（E错，为本题正确答案）。